男孩，3岁。发现右上腹部包块2周。无腹痛、腹胀，大便正常。无肉眼血尿。查体：右上腹部可触及直径约8cm包块，表面光滑，质地较硬，无压痛，可活动。首先考虑的疾病是
A. 肾结核
B. 神经母细胞瘤
C. 多囊肾
D. 肾积水
E. 肾母细胞瘤

正确答案：E。肾母细胞瘤

解析：患者3岁幼儿，发现右上腹部包块，无腹痛、腹胀，大便正常，无肉眼血尿（即无症状的腹部肿块），查体：右上腹部可触及直径约8cm包块，表面光滑，质地较硬，无压痛，可活动（肾母细胞瘤肿块特征），综合患者的年龄、症状和体征，考虑诊断为肾母细胞瘤（E对）。肾母细胞瘤须与巨大肾积水、神经母细胞瘤鉴别。肾结核（A错）常发生于20～40岁的青壮年，男性较女性多见，儿童和老人发病较少，儿童发病多在10岁以上，婴幼儿罕见（P545）。巨大肾积水（D错）柔软、囊性感，超声检查易与肿瘤鉴别。神经母细胞瘤（B错）可以直接广泛侵入肾脏，此瘤一般表面有结节，比较靠近腹中线，儿茶酚胺代谢产物的测定可助于确定诊断（P565）。多囊肾（C错）多有遗传性，多有肾功能减退，以及合并有多囊肝等表现。